为提高诊断试验的特异度，对几个独立实验可
A. 串联使用
B. 并联使用
C. 先串联后并联使用
D. 要求每个实验假阳性率低
E. 要求每个实验特异度低

正确答案：A。串联使用

解析：本题考查串联试验的特点。串联试验（A对BCDE错），也称系列试验，即一组筛检试验按一定的顺序相连，初筛阳性者进入下一轮筛检，全部筛检试验结果均为阳性者才定为阳性。该法可以提高特异度，但会使灵敏度降低。